乳牙牙髓切断术中，如使用FC（戊二醛）进行操作，则戊二醛的浓度为
A. 0.1
B. 0.01
C. 0.05
D. 0.005
E. 0.02

正确答案：E。0.02

解析：本题考查乳牙牙髓病及根尖周病诊断及治疗。FC（戊二醛）断髓术中的牙髓组织断面止血后，将蘸有2%（E对）或者1:5FC的棉球置于牙髓断面，使之与牙髓组织接触1分钟，应避免使用压力将药液压入根管内。